下列哪项与新生儿破伤风诊断无关
A. 有非科学接生史
B. 牙关紧闭
C. 苦笑面容
D. 肌痉挛
E. 白细胞增多

正确答案：E。白细胞增多

解析：本题考查新生儿破伤风的诊断依据。新生儿破伤风系由因有非科学接生史（A对）而导致破伤风梭状杆菌侵入脐部，产生毒素而引起以牙关紧闭（B对）、苦笑面容（C对）以及全身肌肉强直性痉挛（D对）为特征的急性严重感染性疾病。白细胞增多（E错，为本题正确答案）与新生儿破伤风诊断无关。白细胞增多有多种病因，其中最常见的原因就是急性细菌感染引起的白细胞增多，如急性细菌引起的化脓性扁桃体炎、化脓性阑尾炎等。